测量某地某病程短的疾病频率时，最能反映有价值信息的指标是
A. 发病率
B. 患病率
C. 死亡率
D. 调整死亡率
E. 病死率

正确答案：A。发病率

解析：本题考查发病率的应用。发病率是指一定期间内，一定范围人群中某病新发生病例出现的频率。发病率（A对BCDE错）是疾病流行强度的指标，反映疾病对人群健康影响的程度，可测量某地某病程短的疾病频率。